有一颞下颌关节紊乱病患者，临床检查见中度张口受限，下颌前伸及偏向右侧时，左侧颞下颌关节区疼痛，下颌偏向左侧时无疼痛，左侧外耳道触诊髁状突后方无压痛，开口时颏点偏向左侧，考虑诊断为
A. 右侧翼外肌功能亢进
B. 右侧翼外肌痉挛
C. 左侧翼外肌功能亢进
D. 左侧翼外肌痉挛
E. 左侧关节盘后区损伤

正确答案：D。左侧翼外肌痉挛

解析：本题考查颞下颌关节疾病。翼外肌痉挛（D对）：主要表现是疼痛和开口受限，引起疼痛和开口受限的机制是翼外肌痉挛。检查时开口轻度受限，开口度2～2.5㎝，被动开口度大于自然开口度，开口时下颌偏向患侧。翼外肌相应面部（下关穴处和上颌结节后上方）有压痛，但无红肿，关节区无压痛。